询问病史的伦理要求是
A. 平等相待，廉洁奉公
B. 积极进取，保证安全
C. 精诚团结，密切协作
D. 耐心倾听，正确引导
E. 关心体贴，减少痛苦

正确答案：D。耐心倾听，正确引导

解析：诊治的基本伦理要求：1.既要关注疾病，又要关心病人；2.既要发挥医务人员的主导性，又要调动病人的主体性（D对）；3.既要维护病人利益，又要兼顾社会公益。精诚团结，密切协作（P116）（C错）为手术中的伦理要求。